患者，女，28岁。因风温肺热病失治而见身热夜甚，时有谵语，咳喘气促，舌謇肢厥，舌质红绛，脉细数。治疗应首选
A. 参附汤
B. 紫雪散
C. 生脉散
D. 清营汤
E. 竹叶石膏汤

正确答案：D。清营汤

解析：患者因风温肺热病失治，热传于里而伤阴，故见身热夜甚，热扰心神故时有谵语，热入心包故舌謇肢厥，舌质红绛，脉细数均为热盛伤阴之侯，治疗应清营凉血，理气定喘，代表方为清营汤加减（D对）。参附汤（A错）可回阳、益气、固脱，治疗阳气暴脱证。紫雪散（B错）可清热开窍，熄风止痉，治疗温热病，热邪内陷心包，热盛动风证。生脉散（C错）可益气养阴，敛汗生脉，治疗气阴两伤证。竹叶石膏汤（E错）可清热生津，益气和胃，治疗热病后期，余热未清，气津两伤证。